舌尖部淋巴管大部分引流至
A. 颏下淋巴结
B. 颌下淋巴结
C. 咽淋巴结
D. 颈深下淋巴结
E. 颈深上淋巴结

正确答案：A。颏下淋巴结

解析：舌的淋巴管极为丰富，舌尖淋巴管大部分至颏下淋巴结，另一部分至颈肩胛舌骨肌淋巴结。掌握“腭、舌、舌下区的局部解剖”知识点。